阳明病，发热汗多者，治宜选用
A. 白虎汤
B. 白虎加人参汤
C. 大承气汤
D. 小承气汤
E. 调胃承气汤

正确答案：C。大承气汤

解析：论阳明腑实见发热汗多者，治当急下。此阳明病当为阳明腑实之证。一般而言，阳明腑实证，燥热敛结，虽能迫津外泄，不致大汗，多见手足溅然汗出。此证发热汗多，阴津消耗迅速，有热极津涸之虞，即使腹痛、潮热、谵语等症不甚显著，也应当机立断，用大承气汤（C对）急下存阴，否则必陷真阴涸竭之危境。值得注意的是，阳明病发热汗出，为里热炽盛逼迫津液外泄所致，白虎汤证和承气汤证皆可见。但既言急下，必须是有可下之证，在阳明腑实证前提下，见阴津消亡过快，方可用大承气汤急下。正如尤在泾《伤寒贯珠集》说：“此条必有实满之证而后可下，不然则是阳明白虎证。”可参。